分泌肠毒素，激活环磷酸腺苷介质系统引起小肠过度分泌，造成剧烈水泻
A. 痢疾杆菌
B. 伤寒杆菌
C. 霍乱弧菌
D. 大肠杆菌
E. 副伤寒甲杆菌

正确答案：C。霍乱弧菌

解析：霍乱弧菌（C对）可分泌肠毒素，激活环磷酸腺苷介质系统，刺激隐窝细胞分泌水、氯化物及碳酸氢盐的功能增强，同时抑制绒毛细胞对钠的正常吸收，以致大量水分和电解质聚集在肠腔，引起小肠过度分泌，造成剧烈水泻。痢疾杆菌（A错）在肠黏膜上皮细胞和固有层中繁殖、释放毒素，引起肠黏膜炎症反应和固有层小血管循环障碍，导致肠黏膜炎症、坏死及溃疡，患者出现腹痛、腹泻及脓血便，直肠受剌激出现里急后重，细菌内毒素入血可致发热等全身中毒症状，严重者可引起急性微循环障碍，出现感染性休克、DIC或中毒性脑病等。伤寒杆菌（B错）导致单核-巨噬细胞系统的增生性反应，回肠下段附近肠系膜淋巴结常出现明显肿大、充血，伤寒杆菌随血液循环进入肝、脾、胆囊、骨髓、肾等器官组织中大量繁殖播散，释放内毒素，导致菌血症，患者出现发热、全身不适等症状。大肠杆菌（D错）是人和动物肠道中的正常栖居菌，亦可成为致病菌，可释放多种毒力因子、黏附素、外毒素、肠毒素等，导致急性腹泻及肠道外感染等。副伤寒甲杆菌（E错）的发病机理与病理变化与伤寒大致相同，但肠道病变一般较轻，肠壁可无溃疡形成。